善治石淋与肝胆结石的药是
A. 茵陈
B. 萹蓄
C. 灯心草
D. 瞿麦
E. 金钱草

正确答案：E。金钱草

解析：本题考查的是金钱草的主治病证。善治石淋与肝胆结石的药是金钱草（E对）。金钱草：【主治病证】（1）热淋，石淋。（2）湿热黄疸，肝胆结石。（3）热毒疮肿，毒蛇咬伤。茵陈（A错）：【主治病证】（1）黄疸。（2）湿疮，湿疹瘙痒。萹蓄（B错）：【主治病证】（1）热淋涩痛。（2）蛔虫病，蛲虫病。（3）湿疹，阴痒。灯心草（C错）：【主治病证】（1）热淋。（2）心烦失眠，小儿夜啼，口舌生疮。瞿麦（D错）：【主治病证】（1）热淋，血淋，石淋。（2）瘀血闭经。